下列哪项属于药性升浮药物的功效
A. 止咳平喘
B. 渗湿利尿
C. 息风潜阳
D. 祛风散寒
E. 清热泻下

正确答案：D。祛风散寒

解析：止咳平喘药物中，有的偏于止咳，有的偏于平喘，有的则兼而有之。具有平喘作用的药物一般属沉降药（A错）。利水渗湿药物作用趋向偏于下行，属沉降药（B错）。息风潜阳多为质重之介类或矿石类药物，属沉降药（C错）。祛风散寒药物性味多属辛温，辛以发散，温可去寒，属升浮药（D对）。清热药物药性寒凉，沉降入里，属沉降药，泻下药物为沉降之品，属沉降药（E错）。